治疗口腔溃疡时，涂于溃疡面上，连续两次，用于进食前暂时止痛的药物是
A. 冰硼咽喉散
B. 甲硝唑口腔粘贴片
C. 地塞米松粘贴片
D. 西地碘含片
E. 达克罗宁液

正确答案：E。达克罗宁液

解析：本题考查口腔溃疡药的使用。治疗口腔溃疡时，涂于溃疡面上，连续两次，用于进食前暂时止痛的药物是达克罗宁液（E对）。达克罗宁液涂于溃疡面上，连续两次，用于进食前暂时止痛。冰硼咽喉散（A错）是中医传统治疗口腔溃疡的主要用药。应用时取少量，吹敷于患处，一日3次。甲硝唑口腔粘贴片（B错）黏附于黏膜患处，一次1片，一日3次，饭后用，临睡前加用1片。地塞米松粘贴片（C错）具有很强的抗炎作用，降低毛细血管的通透性，减少炎症的渗出，贴片用量较小而作用直接、持久，可促进溃疡愈合；外用贴敷于溃疡处，每处1片，一日总量不得超过3片，连续使用不得超过1周。西地碘含片（D错）可直接卤化细菌的体蛋白，含服，一次1.5～3.0mg，一日3～5次。